下列各项，与机体易感外邪的原因密切相关的是
A. 气推动的功能减弱
B. 气温煦的功能减弱
C. 气营养的功能减弱
D. 气固摄的功能减弱
E. 气防御的功能减弱

正确答案：E。气防御的功能减弱

解析：气的防御功能，气既能护卫肌表，防御外邪入侵，同时也可以祛除侵入若体内的病邪。若气防御功能减弱，邪气易于侵入机体，使机体易感外邪（E对）。气的推动作用，是指阳气的激发、兴奋、促进等作用。若气的推动功能减弱，则脏腑机能减弱，精气血津液的生成、输布、代谢减缓，运行不畅， 精神抑制，可见精瘀、血瘀、痰饮、精神委顿等病症（A错）。气的温煦作用，是指阳气的促进产热，消除寒冷，使人体温暖的作用。若气温煦功能减弱，阳气不足，产热过少，可见虚寒性病变，表现为畏寒喜暖，四肢不温，体温低 下，脏腑生理活动减弱，精血津液代谢减弱、运行迟缓等（B错）。气无营养作用（C错）。固摄作用，是指气对于体内血、津液、精等液态物质的固护、统摄和控制作用，从而防止这些物质无故流失，保证它们在体内发挥正常的生理功能。若气的固摄作用减弱，则有可能导致体内液态物质的大量丢失（D错）。